香加皮含
A. 黄酮类成分
B. 蒽醌类成分
C. 强心苷类成分
D. 挥发油
E. 生物碱类成分

正确答案：C。强心苷类成分